男，40岁。术后粘连性肠梗阻3天，加重1天。查体：可见肠蠕动波，肠鸣音亢进，右下腹有局限性压痛。多次立位腹部X线平片可见固定肠袢。正确的治疗措施是
A. 继续补液、观察病情变化
B. 注射吗啡止痛
C. 灌肠治疗
D. 剖腹探查
E. 出现腹膜刺激征后手术

正确答案：D。剖腹探查

解析：青年男性患者，术后粘连性肠梗阻3天，立位腹部X线平片可见固定肠袢，应考虑为完全性肠梗阻。完全性粘连性肠梗阻需及时剖腹探查，解除梗阻，以免病情恶化，发生绞窄（D对E错）。继续补液观察病情变化（A错）为一般辅助治疗，不是该患者最主要的治疗措施。肠梗阻时应慎用吗啡等止痛药，以免掩盖病情，延误诊治（B错）。灌肠治疗（C错）一般用于治疗老年人粪块堵塞导致的肠梗阻及部分小儿肠套叠。